畸形中央尖属于
A. 牙结构异常
B. 牙形态异常
C. 牙数目异常
D. 牙萌出异常
E. 牙损伤

正确答案：B。牙形态异常

解析：本题考查牙形态异常。牙形态异常包括过大牙、过小牙、锥形牙、融合牙、双生牙、结合牙、畸形中央尖（B对）、牙内陷、釉珠。牙结构异常包括釉质发育不全、遗传性牙本质障碍、先天性梅毒牙（A错）。牙数目异常包括额外牙和先天缺牙（C错）。牙萌出异常包括早萌、萌出过迟、异位和萌出困难（D错）。牙损伤包括牙震荡，牙折，牙脱位等（E错）。